饮水加氟防龋效果乳牙比恒牙低是因为
A. 氟不能完全通过胎盘屏障
B. 氟不容易与乳牙釉质结合
C. 乳牙钙化时孕妇摄氟不足
D. 恒牙矿化程度高于乳牙
E. 乳牙中有机物含量高于恒牙

正确答案：A。氟不能完全通过胎盘屏障

解析：防龋基质是在牙齿开始钙化中就开始，并非从暴露口腔开始。乳牙在母体内已经开始钙化。饮水加氟防龋效果乳牙比恒牙低是因为氟不能完全通过胎盘屏障。如局部使用氟化物防龋效果比较恒牙优于乳牙的是恒牙矿化程度高于乳牙。掌握“氟的全身及局部应用”知识点。